依据《药品流通监督管理办法》，药品零售企业销售药品时开具销售凭证的内容至少应包含
A. 药品名称、数量、价格、生产厂商、批号、规格
B. 药品名称、数量、批准文号、生产厂商、批号
C. 药品名称、数量、规格、生产厂商
D. 药品名称、价格、规格、生产厂商
E. 药品名称、数量、剂型、生产厂商

正确答案：A。药品名称、数量、价格、生产厂商、批号、规格

解析：本题考查的是药品零售企业药品销售管理。依据《药品流通监督管理办法》，药品零售企业销售药品时开具销售凭证的内容至少应包含药品名称、数量、价格、生产厂商、批号（A对）。药品零售企业药品销售管理：销售药品应当符合以下要求：处方经执业药师审核后方可调配；对处方所列药品不得擅自更改或者代用，对有配伍禁忌或者超剂量的处方，应当拒绝调配，但经处方医师更正或者重新签字确认的，可以调配；调配处方后经过核对方可销售；处方审核、调配、核对人员应当在处方上签字或者盖章，并按照有关规定保存处方或者其复印件；销售近效期药品应当向个人消费者告知有效期；销售中药饮片做到计量准确，并告知煎服方法及注意事项；提供中药饮片代煎服务，应当符合国家有关规定。企业销售药品应当开具销售凭证，内容包括药品名称、生产厂商、数量、价格、批号、规格等，并做好销售记录。药品在售出时，应当执行追溯体系的规定。